出现持续青紫伴杵状指，最可能的疾病是
A. 房间隔缺损
B. 室间隔缺损
C. 动脉导管未闭
D. 肺动脉狭窄
E. 法洛四联症

正确答案：E。法洛四联症